以下关于黏液性腺泡的叙述，不正确的是
A. 呈管状，由黏液细胞组成
B. 光镜下黏液细胞呈锥体形
C. 胞质内含丰富的黏原颗粒
D. 染色过程中见透明呈网状结构
E. 能形成半月板的结构

正确答案：E。能形成半月板的结构

解析：黏液性腺泡呈管状，由黏液细胞组成。光镜下，黏液细胞呈锥体形。胞质内含丰富的黏原颗粒，在固定及染色过程中，黏原颗粒常被破坏，故胞质透明呈网状结构。掌握“唾液腺组织结构”知识点。